固位体设计哪项是错误的
A. 嵌体的固位效果最差
B. 桥体跨度越长，越弯曲，（牙合）力越大者，固位体的固位力越小
C. 基牙两端的固位体固位力应基本相等
D. 各固位体之间必须有共同的就位道
E. 应防止基牙牙尖折裂

正确答案：B。桥体跨度越长，越弯曲，（牙合）力越大者，固位体的固位力越小

解析：本题考查固位体的设计。在固位体设计时，桥体跨度越长，越弯曲，（牙合）力越大者，固位体的固位力越大（B错，为本题的正确答案）。嵌体固位体属于冠内固位体，不易获得良好固位形且固位力主要来源于粘接力，故相对于全冠、部分冠等冠外固位体来说，嵌体的固位效果最差（A对）。为防止固定桥翘动，双端固定桥两端的固位力应基本相等（C对）。在选择固位体时，各固位体之间必须有共同的就位道（D对）以便于戴入。固位体的设计应保护基牙，冠内固位体则应该注意在（牙合）面的扩展，对于薄壁弱尖，适当降低牙尖高度，并将其覆盖，从而避免发生牙尖折裂。因此，固位体的设计还应防止基牙牙尖折裂（E对）。